恒温恒湿作业的通风措施主要应采用
A. 全面自然通风
B. 局部自然通风
C. 天窗
D. 送入式机械通风
E. 排气罩

正确答案：D。送入式机械通风